下列各项，不属丙型肝炎传播途径的是
A. 静脉注射
B. 粪-口
C. 输血
D. 母婴传播
E. 性接触

正确答案：B。粪-口

解析：丙型肝炎2.传播途径 类似乙型肝炎，主要通过肠道外途径传播。（1）血液、体液传播 输血及血制品曾是最主要的传播途径，随着筛查方法的改善，此传播方式已得到明显控制。注射、针刺、器官移植、骨髓移植、血液透析等均可传播（AC对）。密切的生活接触、性接触（E对）等亦可能传播。（2）母婴传播（D对）HCV RNA阳性母亲传播给新生儿的概率为4%～7%（B错，为本题正确答案）。